下颌侧切牙与上颌侧切牙的区别中哪点是错误的
A. 下颌侧切牙唇面较平
B. 下颌侧切牙边缘嵴较明显
C. 上颌侧切牙唇面较圆
D. 下颌侧切牙为扁根
E. 邻面观上颌侧切牙的切嵴在牙体长轴的唇侧

正确答案：B。下颌侧切牙边缘嵴较明显

解析：本题考查牙体解剖外形。下颌侧切牙边缘嵴较明显（B错，为本题正确答案）不属于下颌侧切牙与上颌侧切牙的区别，上颌切牙的舌窝较深，舌面边缘嵴明显；下颌切牙的舌窝较窄浅，舌面边缘嵴不明显。下颌侧切牙与上颌侧切牙的区别有：上颌切牙牙冠宽大，发育沟明显，下颌切牙牙冠窄小，唇面光滑，发育沟不明显；上颌侧切牙唇面较圆（C对），下颌侧切牙唇面较平（A对）；上颌侧切牙牙根直而粗壮，下颌侧切牙牙根扁而窄（D对）；邻面观上颌侧切牙的切嵴在牙体长轴的唇侧（E对），下颌侧切牙的切嵴靠近牙体长轴或略偏舌侧。